患儿10岁，上前牙牙龈时常流脓1月余。查左上1远中舌面深龋，探无反应，无穿髓孔，牙松动Ⅰ度，叩（+），冷测无反应，唇侧牙龈近根尖处有一窦道。为确定诊断，临床需要作的检查是X线片，临床拟诊断为
A. 急性牙髓炎
B. 慢性牙髓炎
C. 急性根尖周炎
D. 慢性根尖周炎
E. 牙周脓肿

正确答案：D。慢性根尖周炎

解析：本题考查慢性根尖周炎的临床表现及诊断。根据病例描述，左上1远中舌面深龋，探无反应，无穿髓孔，冷热测无反应，可知患牙牙髓已坏死；上前牙牙龈时常流脓1月余，松I度，叩痛（+），唇侧牙龈近根尖处有一窦道口，可知患牙牙髓炎症已蔓延到根尖周，导致根尖周炎症，综上所述，可初步诊断为慢性根尖周炎（D对）。急性牙髓炎（A错）表现为阵发性自发性剧烈的疼痛，夜间痛，放射痛，疼痛不能定位，病例中未述剧烈疼痛。慢性牙髓炎（B错）时炎症局限在牙髓腔内，并没有蔓延至根尖，因此不会有流脓、窦道口等表现。急性根尖周炎（C错）有明显自发痛，疼痛剧烈，叩痛剧烈。牙周脓肿（E错）一般有牙周袋形成和牙槽骨吸收，对冷热测正常，而不是没反应。